不属于牙周病的流行特征的是
A. 具有一定的时间分布特征
B. 随年龄增长牙周炎患病率逐渐下降
C. 牙周病与性别的关系不明确
D. 我国少数民族中患病率最高的是彝族
E. 具有一定的地区分布特征

正确答案：B。随年龄增长牙周炎患病率逐渐下降

解析：年龄分布：牙周病患病率随年龄增长而增高。5～6岁就可能患龈炎，以后随年龄增长，部分龈炎逐渐发展成牙周炎，龈炎患病率逐渐下降，但牙周炎患病率逐渐上升。掌握“牙周病流行病学及分级预防”知识点。